分离鉴定和莪术挥发油的有效方法是
A. 气相色谱-质谱法
B. 高效液相色谱法
C. 薄层色谱法
D. 柱色谱法
E. 纸色谱法

正确答案：A。气相色谱-质谱法

解析：本题考查的是莪术挥发油的分离鉴定。分离鉴定和莪术挥发油的有效方法是气相色谱-质谱法（A对）。莪术含挥发油1.0%～2.5%，《中国药典》规定原药材含挥发油不得少于1.5%（ml/g），饮片含挥发油不得少于1.0%（ml/g）。经用气相色谱-质谱联用法（GC-MS）分析测定。其中吉马酮、莪术醇、莪术二醇、莪术酮及莪术二酮等为倍半萜类化合物，是莪术挥发油的主要有效成分。高效液相色谱法（B错）是判断有效成分纯度的一种重要方法，具有样品用量小、操作时间快、灵敏度高和准确等优点。该方法发展迅速，同时具有分离和分析鉴定的用途，已成为中药化学的常规分析方法。薄层色谱法（C错）与纸色谱法（E错）属于色谱法。色谱法是鉴定结晶纯度的一种常用方法。常用的色谱法有纸色谱、纸上电泳和薄层色谱。纸色谱法实质上也是液液萃取法的原理，只是两相中其中一相以固态为基质，与某种液相形成饱和状态，进而达到分离的目的。柱色谱法（D错）：柱色谱可分为分配柱色谱和吸附柱色谱两种原理。高效液相色谱法属于柱色谱法。